毛果芸香碱的作用是
A. 直接作用于受体
B. 影响递质的储存
C. 影响代谢酶
D. 影响递质的释放
E. 影响递质的生物合成

正确答案：A。直接作用于受体

解析：毛果芸香碱能直接作用于副交感神经（包括支配汗腺交感神经）节后纤维支配的效应器官的M胆碱受体（A对），尤其对眼和腺体作用明显。对眼的作用有：缩瞳、降低眼内压和调节痉挛；对腺体：促进腺体分泌。临床应用于：青光眼、虹膜睫状体炎。